前唇原长法整复
A. 单侧完全唇裂
B. 双侧不完全唇裂
C. 不完全腭裂
D. 双侧完全腭裂
E. 单侧完全腭裂

正确答案：B。双侧不完全唇裂

解析：本题考查唇腭裂的整复方法。前唇原长法整复双侧不完全唇裂（B对）。双侧唇裂的整复通常是围绕前唇的形态进行设计和手术。在手术中对于前唇长度的设计一般可分为保留前唇长度的原长法和利用侧唇增加前唇长度的加长法。单侧完全唇裂（A错）多采用旋转推进法整复。腭裂（CDE错）多采用提肌重建手术，腭咽成形术等术式。